女性，26岁。10天来全身皮肤出血点伴牙龈出血来诊。化验plt35×10⁹/L，临床诊断为慢性特发性血小板减少性紫癜（ITP）。该患者的首选治疗是
A. 糖皮质激素
B. 脾切除
C. 血小板输注
D. 长春新碱
E. 达那唑

正确答案：A。糖皮质激素

解析：患者已诊断为慢性特发性血小板减少性紫癜（ITP），首选的治疗为糖皮质激素（A对），近期有效率达80%。脾切除（P616）（B错）、长春新碱（P616）（D错）为ITP的二线治疗，主要适用于糖皮质激素无效或禁忌者；血小板输注（P616）（C错）主要用于ITP急症的对症处理；达那唑（P549）（E错）为雄激素，可刺激造血，主要用于再生障碍性贫血的治疗。